患儿，男，出生时Apgar评分4分，生后2天嗜睡，肌张力减退，瞳孔缩小，时而出现惊厥，头颅CT扫描，可见右叶有低密度影。控制该患儿的惊厥，应首选什么药物
A. 安定肌注
B. 水合氯醛灌肠
C. 甘露醇
D. 苯巴比妥钠
E. 利尿剂

正确答案：D。苯巴比妥钠

解析：患儿，出生时Apgar评分4分（提示出生时新生儿轻度窒息），生后2天嗜睡，肌张力减退，瞳孔缩小（新生儿缺氧缺血性脑病的典型临床表现），时而出现惊厥（提示重度），头颅CT扫描，可见右叶有低密度影，根患儿的病史、临床症状、体征及实验室检查，考虑最可能的诊断为新生儿缺氧缺血性脑病，控制该患儿的惊厥，应首选苯巴比妥（D对），该药能控制惊厥，从而降低脑细胞代谢。